具有活血，凉血功效的药组是
A. 延胡索，姜黄
B. 土鳖虫，乳香
C. 郁金，丹参
D. 姜黄，红花
E. 水蛭，莪术

正确答案：C。郁金，丹参

解析：丹参苦泻性寒，归心肝经，主入血分，既能活血化瘀，调经止痛，祛瘀生新，又能凉血活血，散瘀消痈；郁金性寒辛散苦泻，既能活血祛淤止痛，疏肝行气解郁，也能清降火热，解郁顺气，凉血止血（C对）。